流行病学中与发病相关的常用指标除了发病率外还包括
A. 死亡率、续发率
B. 死亡率、流行率
C. 死亡率、病死率
D. 病死率、流行率
E. 罹患率、患病率

正确答案：E。罹患率、患病率

解析：流行病学中与发病相关的常用指标除了发病率外还包括罹患率、患病率（E对），三者均可以用来评价发病相关的情况。由于本题中未涉及死亡患者，因此与死亡率和病死率不符合题意（ABCD错）。